可使液态物料瞬间干燥的方法是
A. 冷冻干燥
B. 红外线干燥
C. 喷雾干燥
D. 微波干燥
E. 沸腾干燥

正确答案：D。微波干燥

解析：本题考查的是微波干燥的优点。可使液态物料瞬间干燥的方法是微波干燥（D对）。微波干燥养护的优点：（1）干燥迅速。因微波可深入物料的内部，故只需常规方法的1/100至1/10的时间即可完成加热过程。（2）产品质量好。由于加热时间短，则水分吸热量大而排出，而物料本身吸热却很少，不会过热，仍可保持原有的色香味，有效成分也较少破坏，因此产品质量较高。此外，微波还具有消毒作用，有益于防止饮片发霉、生虫。（3）加热均匀。由于微波加热是从饮片内部直接进行的，故无论被加热饮片形状如何不规则，加热也可相当均匀，不会有外焦内生、表面硬化等现象产生。（4）热效率高。由于热量直接来自干燥物内部，因此热量在周围大气中损耗极少。（5）反应灵敏。常规的加热方法如电热、蒸汽、热空气等，达到一定温度需要预热一段时间，而停止加热时，温度下降又需较长时间。采用微波干燥在开机5分钟后即可正常运转，而且是自动控制，容易操作。冷冻干燥（A错）、红外线干燥（B错）、喷雾干燥（C错）与沸腾干燥（E错），2022年考试指南未明确说明。